女，68岁。反复咳嗽、咳痰20年，气喘10年，加重伴下肢水肿一周入院。高血压病史10余年，BP145/90mmHg。查体：T37.8℃，口唇发绀，BP135/80mmHg，双下肺散在湿啰音和哮鸣音，肝肋下3cm，肝颈静脉回流征阳性，双下肢水肿。WBC9.3×10⁹/L，N0.78。该患者最可能的诊断是
A. 支气管哮喘
B. 急性右心衰
C. 慢性阻塞性肺病
D. 支气管扩张
E. 肺结核

正确答案：B。急性右心衰

解析：患者老年女性，有长期高血压病史，反复咳嗽、咳痰20年，气喘10年（提示有慢性阻塞性肺疾病），查体：口唇发绀，双下肺散在湿啰音和哮鸣音，肝肋下3cm（提示肝大），肝颈静脉回流征阳性，双下肢水肿（右心衰竭的常见体征），该患者最可能的诊断是长期慢性阻塞性肺疾病导致的急性右心衰（B对），而不是单纯的慢性阻塞性肺疾病（C错）。支气管哮喘（P28）（A错）典型的体征是双肺可闻及广泛的哮鸣音，呼气音延长。支气管扩张（P37）（D错）主要表现为慢性咳嗽、咯大量脓痰和（或）反复咯血。肺结核（P65）（E错）主要表现为低热、盗汗、乏力、消瘦等。